下列哪种情况易发生脱水热
A. 低渗性脱水
B. 等渗性脱水
C. 高渗性脱水
D. 水中毒
E. 水肿

正确答案：C。高渗性脱水

解析：高渗性脱水（C对）时，由于细胞外液高渗，可使渗透压相对较低的细胞内液向细胞外转移，细胞内液明显减少，使汗腺分泌减少，皮肤蒸发的水分也减少，散热功能受到影响，可出现体温升高，称为脱水热。低渗性脱水（A错）和等渗性脱水（B错）时一般无发热症状。水中毒（D错）时患者水潴留使体液量明显增多，水肿（E错）为过多的液体在组织间隙或体腔内积聚，二者不出现脱水。